支气管哮喘12年，规律吸入糖皮质激素。近2周再次出现喘息发作，夜间症状明显。不宜采取的治疗是
A. 加用长效茶碱
B. 加用小剂量口服激素
C. 增加吸入激素剂量
D. 加用短效β₂激动剂
E. 加长效β₂激动剂

正确答案：C。增加吸入激素剂量

解析：患者支气管哮喘12年，规律吸入糖皮质激素，近2周再次出现喘息发作，夜间症状明显，若增加吸入激素剂量，可能产生全身性不良反应，故不宜采取的治疗是增加吸入激素剂量（C错，为本题正确答案）。长效茶碱（A对）对于夜间哮喘的控制具有良好效果，且小剂量缓释茶碱与ICS联合是目前常用的哮喘控制性药物之一。患者可加用小剂量口服激素（B对），口服激素适用于吸入激素无效或需要短期加强治疗的患者。吸入激素与β₂激动剂联合使用（DE对），可避免吸入大剂量激素，并增强对哮喘的控制作用。